以下不属于4岁以后乳牙（牙合）特征的是
A. 牙排列不紧密，前牙间隙逐渐形成
B. 牙的切缘及（牙合）面产生显著磨耗
C. 上、下第二乳磨牙的远中面在同一平面上
D. 随下颌升支发育，暂时性深覆（牙合）减小
E. 下颌第二乳磨牙移至上颌第二乳磨牙的稍前方

正确答案：C。上、下第二乳磨牙的远中面在同一平面上

解析：4～6岁期间的特征：随着颌骨的长大，牙排列不紧密，前牙间隙逐渐形成；牙的切缘及（牙合）面产生显著磨耗；下颌第二乳磨牙移至上颌第二乳磨牙的稍前方（近中）；随下颌升支发育，暂时性深覆（牙合）减小。掌握“（牙合）的生长发育”知识点。